考核预防接种效果包括
A. 免疫学效果评价和统计分析
B. 细菌学评价和免疫学效果评价
C. 流行病学评价和统计学分析
D. 流行病学评价和免疫学效果评价
E. 流行病学评价和统计分析

正确答案：D。流行病学评价和免疫学效果评价

解析：本题考查预防接种效果的考核。考核预防接种效果包括免疫学效果评价、流行病学效果评价（D对ABCE错）和免疫规划管理评价。